目前颅内动脉瘤主要的确诊检查是
A. 腰椎穿刺示血性脑脊液
B. 头颅CT
C. 蛛网膜下腔出血
D. 头痛反复发作史
E. 脑血管造影

正确答案：E。脑血管造影

解析：颅内动脉瘤是先天性或后天性因素导致颅内动脉壁正常结构发生改变， 随着血流的冲击，在动脉壁异常处形成的突起。目前颅内动脉瘤主要的确诊检查是脑血管造影（E对），因其可明确动脉瘤的大小、位置、与载瘤动脉的关系、有无血管痉挛等解剖学特点。蛛网膜下腔出血（C错）及腰椎穿刺示血性脑脊液（A错）可由颅内动脉瘤破裂可渗入蛛网膜下腔导致，但颅内动脉瘤不是导致这两者的唯一原因，且颅内动脉瘤可早期发现，而不是当其破裂后进行回顾性诊断来确诊。头颅CT（B错）对于颅内动脉瘤的诊断效果不如脑血管造影。头痛反复发作史（D错）可见于很多疾病，不能由头痛诊断颅内动脉瘤的存在。